可杀灭物体上细菌、真菌和病毒、非病原微生物和芽孢（胞）的方法是
A. 消毒
B. 灭菌
C. 防腐
D. 无菌
E. 抑菌

正确答案：B。灭菌

解析：灭菌指杀灭物体上所有微生物，包括病原微生物（细菌、真菌和病毒）、非病原微生物和芽孢（胞）的方法。掌握“消毒与灭菌”知识点。